中厚皮片包括
A. 表皮层
B. 表皮+部分真皮层
C. 表皮+真皮全层
D. 表皮+真皮+部分皮下组织
E. 表皮+真皮+皮下组织

正确答案：B。表皮+部分真皮层

解析：本题考查中厚皮片。游离皮瓣移植可按皮肤厚度分为三种：表层皮片及刃厚皮片、中厚皮片、全厚皮片，中厚皮片包括表皮+部分真皮层（B对），一般用于口腔内植皮。表层皮片（刃厚皮片），它含表皮+真皮乳头，表层皮片生活能力强，可用于感染的创面或骨面。全厚皮片也称Wolfe-Krause皮片，它包括表皮+真皮全层（C错），全厚皮片有弹性、能耐磨擦和负担重力，色泽变化不大，故在面部多用。而表皮+真皮+皮下组织是人体皮肤的组成（E错）。